阿胶的功效是
A. 补血止血
B. 补血行血
C. 补血柔肝
D. 补血益气
E. 补血温肺

正确答案：A。补血止血

解析：阿胶具有补血，滋阴，润肺，止血的功效（A对）。应用于血虚诸证，出血证，肺阴虚燥咳，热病伤阴，心烦失眠，阴虚风动，手足瘛瘲的治疗。